苯二氮草类药物的作用机制是
A. 直接和GABA受体结合，增加GABA神经元的功能
B. 与苯二氮草受体结合，生成新的抑制性蛋白起作用
C. 不通过受体，直接抑制中枢神经系统的功能
D. 与其受体结合后促进GABA与相应受体结合，增加CI⁻通道开放频率
E. 与其受体结合后促进GABA与相应受体结合，增加CI⁻通道开放的时间

正确答案：D。与其受体结合后促进GABA与相应受体结合，增加CI⁻通道开放频率